接受清洁手术者，在术前给予抗菌药物的适宜时间是
A. 0.5小时～2小时
B. 2小时～3小时
C. 2小时～4小时
D. 3小时～6小时
E. 4小时～8小时

正确答案：A。0.5小时～2小时

解析：本题考查抗菌药物的使用。清洁手术前必须掌握八项原则，包括：必须选择杀菌剂；以静脉滴注途径给药；以小容积量溶剂稀释，在短时间滴注；给药时间应在术前0.5～2小时（A对）。